女，35岁，近5年来间断头痛，每月发作1-2次，MRI示左顶枕脑内蜂窝样血管流空影，呈楔形。该患者最佳治疗方案是
A. 药物栓塞
B. 手术
C. 射频消融
D. 血管内介入治疗
E. 无需处理

正确答案：D。血管内介入治疗

解析：中青年患者，近5年来间断头痛，每月发1-2次，MRI示左顶枕脑内蜂窝样血管流空影（脑动静脉畸形的典型核磁表现），呈楔形，患者最可能的诊断是脑动静脉畸形，该患者最佳治疗方案是血管内介入治疗（D对），该方法具有时间短，创伤小，恢复快的优点。